具有营养全身和化生血液作用的气是
A. 元气
B. 宗气
C. 营气
D. 卫气
E. 脏腑之气

正确答案：C。营气

解析：营气的生理功能有化生血液和营养全身两个方面（C对）。元气的生理功能主要有二个方面，一是推动和调节人体的生长发育和生殖机能，二是推动和调控各脏腑、经络、形体、官窍的生理功能（A错）。宗气的生理功能有行呼吸、行气血和资先天三个方面（B错）。卫气有防御外邪、温养全身和调控腠理的生理功能（D错）。脏腑之气和经络之气是全身之气的一部分，一身之气分布到某一脏腑或某一经络，即成为某一脏腑或某一经络之气。这些气是构成各脏腑、经络的基本物质，又是推动和调控各脏腑、经络进行生理活动的基本物质（E错）。